巯嘌呤的化学名为
A. 7-嘌呤巯醇一水合物
B. 6-嘌呤巯醇一水合物
C. 4-嘌呤巯醇一水合物
D. 2-嘌呤巯醇一水合物
E. 1-嘌呤巯醇一水合物

正确答案：B。6-嘌呤巯醇一水合物